球窝关节
A. 关节头位于关节窝内
B. 两个关节面的形状差异较大
C. 运动范围小
D. 属双轴关节
E. 关节头与关节窝的接触面较大

正确答案：B。两个关节面的形状差异较大

解析：球窝关节: 关节头较大，呈球形，关节窝浅而小，两个关节面的形状差异较大，与关节头的接触面积不到 1/3 （B对E错）。球窝关节运动范围大，可作屈、伸 、收 、展、旋内、旋外和环转运动 （C错）。球窝关节属于多轴关节（D错）。